原核生物大多数基因表达调控实现是通过
A. 解链酶
B. 引物酶
C. RNA聚合酶Ⅲ
D. 操纵子机制
E. RNA聚合酶核心酶

正确答案：D。操纵子机制

解析：原核生物大多数基因表达调控是通过操纵子机制实现的。操纵子通常由2个以上的编码序列与启动序列、操纵序列以及其他调节序列在基因组中成簇串联组成。启动序列是RNA聚合酶结合并启动转录的特异DNA序列。掌握“基因表达调控原理”知识点。